用作软胶囊填充的材料是
A. 药物的油溶液
B. 药物的水溶液
C. 药物的丙酮溶液
D. 药物的乙醇溶液
E. 药物的O/W型乳剂

正确答案：A。药物的油溶液

解析：本题考查的是胶囊囊材的特性。用作软胶囊填充的材料是药物的油溶液（A对）。软胶囊对填充物料的要求：软胶囊可填充各种油类或对囊壁无溶解作用的药物溶液或混悬液，也可充填固体药物。填充物料为低分子量水溶性（B错）或挥发性有机物（如乙醇（D错）、丙酮（C错）、羧酸等）或充填药物的含水量超过5%，会使软胶囊溶解或软化；醛类可使囊膜中明胶变性；O/W型乳剂（E错）会失水破坏，均不宜作为软胶囊的填充物。填充药物混悬液时，分散介质常用植物油或PEG 400。油状介质常用10%～30%的油蜡混合物作助悬剂，而非油状介质则常用1%～15% PEG 4000或PEG 6000。必要时可加用抗氧剂、表面活性剂等附加剂。填充液pH应控制在4.5～7.5之间，强酸性可导致明胶水解而泄漏，强碱性可引起明胶变性而影响溶解释放。填充固体药物时，药粉应过五号筛，并混合均匀。